下列膀胱三角说法，正确的是
A. 位于膀胱体的内面
B. 膀胱壁缺少肌层
C. 位于两侧输尿管口与尿道内口之间
D. 不是膀胱镜检查的主要部位
E. 不是膀胱肿瘤和结核的好发部位

正确答案：C。位于两侧输尿管口与尿道内口之间

解析：膀胱三角位于膀胱底的内面（A错）, 左、右输尿管口和尿道内口之间（C对）, 该区缺少黏膜下层组织（B错），是肿瘤、结核和炎症的好发部位（E错），膀胱镜检查时应特别注意（D错）。